平衡水是指
A. 以物理化学方式与物料结合的水分
B. 以机械方式与物料结合的水分
C. 干燥过程中除不去的水分
D. 干燥过程中能除去的水分
E. 动植物细胞壁内的水分

正确答案：C。干燥过程中除不去的水分